下列除哪项外，均可出现口臭
A. 龋齿
B. 心火
C. 胃热
D. 宿食
E. 内痈

正确答案：B。心火

解析：口臭是指从口中散发臭气者。口臭多与口腔不洁、龋齿、便秘或消化不良有关。故龋齿可见口臭（A错）。口气臭秽者，多属胃热。故胃热可见口臭（C错）。口气酸臭，并伴食欲不振，脘腹胀满者，多属食积胃肠。故宿食可见口臭（D错）。口气腐臭，或兼咳吐脓血者，多是内有溃腐脓疡。故内痈可见口臭（E错）。心火可见口舌生疮非口臭（B对）。